关于病例-对照研究特点不包括哪一项
A. 观察时间短
B. 需要研究的对象少
C. 适合研究一些病程较长的慢性病和一些比较多见的疾病
D. 尤其适合那些原因未明疾病的研究
E. 准确性低，可靠性较差，回忆偏倚较大

正确答案：C。适合研究一些病程较长的慢性病和一些比较多见的疾病

解析：病例-对照研究的特点是观察时间短、需要研究的对象少，适合研究一些病程较长的慢性病和一些比较少见的疾病。又由于它一次可研究多个因素，尤其适合那些原因未明疾病的研究。但由于病例-对照研究是对过去因素的回顾性调查，所以准确性较低，可靠性较差，回忆偏倚较大。掌握“口腔流行病学概述及研究方法”知识点。